缩短快动眼睡眠时相，突然停药可出现戒断症状的药物是
A. 水合氯醛
B. 硫喷妥钠
C. 苯巴比妥
D. 地西泮
E. 格鲁米特

正确答案：C。苯巴比妥